开创了中医学内伤杂病辨证论治体系，对后世临床医学发展有深远影响的著作是
A. 《黄帝内经》
B. 《伤寒论》
C. 《金匮要略》
D. 《温疫论》
E. 《诸病源候论》

正确答案：C。《金匮要略》

解析：本题考查的是主要医学典籍。开创了中医学内伤杂病辨证论治体系，对后世临床医学发展有深远影响的著作是《金匮要略》（C对）。《金匮要略方论》：简称《金匮要略》《金匮》。汉·张机（字仲景）撰著。全书以《内经》理论为指导，理论联系实际，开创了内伤杂病辨证论治的体系，对后世临床医学的发展有深远影响。《黄帝内经》（A错）：又称《内经》，是最早的一部中医典籍，也是中医学最重要的经典著作。《黄帝内经》分《黄帝内经素问》和《灵枢经》两部分。《黄帝内经素问》，简称《素问》，原书9卷，计81篇。大约历经春秋战国至秦汉陆续汇集而成。作为现存最早、最为系统的医学经典著作，全面总结了秦汉以前古代医学的临床经验和理论。充分体现了人与自然统一的整体运动观念，确立了因时、因地、因人制宜的辨证施治原则，形成了独具特色的中医学理论体系，并为其发展奠定了坚定的基础。《灵枢经》，又称《黄帝内经灵枢》，简称《灵枢》。原书九卷，81篇。约成书于春秋战国至秦汉时期。侧重于经络理论和针刺方法，是全面系统总结我国汉代以前中医学理论、经络学说和针刺技术的经典著作，为后世医学尤其是针灸学的发展奠定了坚定的基础。因其详于经络腧穴针灸刺法，故又有《针经》之称。《伤寒论》（B错）：简称《伤寒》，汉·张机（字仲景）撰著。书中总结了先秦两汉时代的医学成就，继承与发展了《内经》的基本理论，创造性地将医学理论与临床实践紧密结合。《温疫论》（D错）：明·吴又可撰于公元1642年。该书为中医史上第一部论温疫的专著，在温病温疫的病因、病机和证治方面突破了《伤寒论》的原有框架，创立了辨治温疫温病的新理论，对后世温病医家有很大启发和影响。《诸病源候论》（E错），即《巢氏诸病源候论》。《巢氏诸病源候论》：又名《诸病源候论》，简称《巢氏病源》，隋·巢元方等撰。成书于隋大业六年（公元610年）。是我国第一本证候学专著。该书继承和发展了中医病因病机学理论，对后世影响很大，为历代医家所推崇。